不正确的是
A. 腹股沟深淋巴结沿股静脉末端内侧排列
B. 腹股沟浅淋巴结的上组沿腹股沟韧带下方横列
C. 腹股沟浅淋巴结的下组沿大隐静脉末部纵列
D. 腹股沟浅淋巴结收纳腘淋巴结的输出管
E. 腹股沟淋巴结的输出管最后注入髂外淋巴结

正确答案：D。腹股沟浅淋巴结收纳腘淋巴结的输出管

解析：腹股沟深淋巴结位于股静脉周围，沿股静脉末端内侧排列（A对），并位于股管内。腹股沟浅淋巴结上群沿腹股沟韧下方横向排列（B对），下群沿大隐静脉末端纵向排列（C对）。腹股沟深淋巴结收纳腹股沟浅淋巴结和腘淋巴结输出淋巴管（D错，为本题正确答案），最后注入髂外淋巴结（E对）。